下列关于罂粟壳的说法正确的有
A. 处方颜色为淡黄色，保存1年备查
B. 成人一次的常用量为每天3～6克
C. 每张处方不得超过3日用量，连续使用不得超过7日
D. 不得单方发药，调配处方时必须凭有麻醉处方权的医师签名的处方

正确答案：B、C、D。成人一次的常用量为每天3～6克；每张处方不得超过3日用量，连续使用不得超过7日；不得单方发药，调配处方时必须凭有麻醉处方权的医师签名的处方

解析：本题考查调剂与临方炮制的主要内容。说法正确的有成人一次的常用量为每天3～6克（B对）；每张处方不得超过3日用量，连续使用不得超过7日（C对）；不得单方发药，调配处方时必须凭有麻醉处方权的医师签名的处方（D对）。罂粟壳不得单方发药，必须凭有麻醉药处方权的执业医师签名的淡红色处方方可调配，每张处方不得超过三日用量，连续使用不得超过七天，成人一次的常用量为每天3～6克。处方保存三年备查（A错）。